心肌梗死患者心脏破裂最常见部位是
A. 左房游离壁
B. 右房游离壁
C. 室间隔
D. 左室游离壁
E. 右室游离壁

正确答案：D。左室游离壁

解析：心脏破裂是心肌梗死的一种少见并发症，常在起病1周内出现，多为心室游离壁破裂，偶为心室间隔破裂（C错）。由于左心室梗死较右心室和左、右心房梗死多见，故左室游离壁是心肌梗死患者心脏破裂最常见部位（D对ABE错）。